患者女性，63岁。慢性咳喘病史30余年，1年来出现双下肢浮肿，1周来咳喘加重。查体：发绀明显，桶状胸，剑突下可见心尖搏动，心率119次/分，率齐，双肺可闻及干湿性啰音，肝肋下1cm，双下肢浮肿（﹢），血常规：白细胞12×10⁹/L；胸片显示：肺气肿，右心室肥大，肺纹理增重。应首先考虑的诊断是
A. 慢性肺源性心脏病失代偿期
B. 支气管哮喘
C. 慢性支气管炎
D. 慢性支气管炎合并肺气肿
E. 慢性肺源性心脏病代偿期

正确答案：A。慢性肺源性心脏病失代偿期

解析：患者女性，60岁，慢性咳喘病史20余年（慢性病病史），1年来出现双下肢浮肿，1周来咳喘加重查体：发绀明显（缺氧和二氧化碳潴留所引起），桶状胸（肺气肿体征），剑突下可见心尖搏动（因为右心室肥厚和扩大），心率119次/分，率齐，双肺可闻及干湿性啰音，肝肋下1cm，双下肢浮肿（﹢）（右心衰竭的表现），血常规：白细胞12×10⁹/L（提示合并感染），胸片显示：肺气肿，右心室肥大，肺纹理增重（A对）。支气管哮喘多在儿童或青少年期起病，常有家族或个人过敏史，以发作性喘息为特征，突发突止，发作时两肺布满哮鸣音，应用解痉药症状可明显缓解，也可自行缓解。哮喘的气流受限多为可逆性，其支气管舒张试验阳性（B错）。支气管炎发生在中年以上的患者，在气候多变的冬春季节咳嗽、咳痰明显，多为白色黏液痰，感染急性发作时可出现脓性痰，但无反复咯血史。听诊双肺可闻及散在干湿啰音（C错）。患者有慢性咳嗽、喘息史，有加重期。有肺气肿体征，两肺可闻及湿啰音（D错）。慢性肺源性心脏病失代偿期的心功能代偿一般良好，肺功能处于部分代偿阶段，患者常有慢性咳嗽、咳痰和喘息，活动后可有心悸、气短、乏力和劳动耐力下降，并有不同程度发等缺氧症状，感染可使上述症状加重（E错）。